毒性中药系指毒性剧烈，治疗剂量与中毒剂量相近，使用不当会致人中毒或死亡的中药。因此执业药师在审核或调剂含有特殊管理毒性中药的处方时，掌握其用法用量非常重要。内服，用量0.05～0.1g，入丸散用的毒性中药是
A. 蟾酥
B. 白降丹
C. 生千金子
D. 雄黄
E. 生马钱子

正确答案：D。雄黄

解析：本题考查的是特殊管理的中药。内服，用量0.05～0.1g，入丸散用的毒性中药是雄黄（D对）。雄黄的用法用量：0.05～0.1g，入丸散用。外用适量，熏涂患处。注意事项：内服宜慎；不可久用；孕妇禁用。蟾酥（A错）的用法用量：0.015～0.03g，多入丸散用。外用适量。注意事项：孕妇慎用。白降丹（B错）的用法用量：外用适量，研末调敷或作药捻。注意事项：不可内服，具腐蚀性。生千金子（C错）的用法用量：内服，1～2g，去壳，去油用，多入丸散服。外用适量，捣烂敷患处。注意事项：孕妇禁用。生马钱子（E错）的用法用量：内服，0.3～0.6g，炮制后入丸散。注意事项：孕妇禁用；不宜生用；不宜多服久服；运动员慎用；有毒成分能经皮肤吸收，外用不宜大面积涂敷。